糖皮质激素长期应用突然停药或减量过快时，容易引起的不良反应是
A. 医源性肾上腺皮质功能亢进症库欣综合征
B. 诱发或加重感染
C. 骨质疏松
D. 肾上腺皮质萎缩和功能不全
E. 诱发或加重消化性溃疡

正确答案：D。肾上腺皮质萎缩和功能不全

解析：糖皮质激素的不良反应：1.长期大剂量应用引起的不良反应①医源性肾上腺皮质功能亢进症：这是长期大剂量应用糖皮质激素引起物质代谢和水盐代谢紊乱的结果（A错）。②诱发或加重感染：由于糖皮质激素抗炎不抗菌，且降低机体的防御功能，细菌易乘虚而入诱发感染（B错）。③消化系统并发症：糖皮质激素可刺激胃酸和胃蛋白酶的分泌，抑制胃黏液分泌，降低胃肠黏膜对胃酸的抵抗力，可诱发或加重胃、十二指肠溃疡（E错）。④心血管系统并发症⑤骨质疏松、肌肉萎缩、延缓伤口愈合：与糖皮质激素促蛋白质分解、抑制其合成及减少钙、磷在肠道的吸收并增加其排泄，抑制成骨细胞活力等有关（C错）。⑥糖尿病、白内障、青光眼⑦其他2.停药反应①医源性肾上腺皮质萎缩和功能不全：长期应用糖皮质激素的病人，体内糖皮质激素浓度高，通过负反馈抑制下丘脑-垂体-肾上腺皮质轴，使ACTH分泌减少，引起肾上腺皮质萎缩和功能不全（D对）②反跳现象。